在A、B两组人群中进行筛选，假定筛选试验的灵敏度和特异度是已知的，A人群患病率为10%，B人群为1%，则下列哪种结论是正确的
A. A人群阳性结果者中真阳性的比例低于B人群
B. A人群中特异度低于B人群
C. A人群中可靠性高于B人群
D. A人群阳性结果者中假阳性者所占比例低于B人群
E. A人群中灵敏度高于B人群

正确答案：D。A人群阳性结果者中假阳性者所占比例低于B人群

解析：本题考查假阳性率。灵敏度和特异度是已知的，A人群患病率为10%，B人群为1%，那么B人群的误诊情况肯定较A严重，假阳性者高于A。因此，A人群阳性结果者中假阳性者所占比例低于B人群（D对ABCE错）。